关于旋后肌，正确的是
A. 使桡骨远端环绕尺骨旋后
B. 是旋后运动的唯一肌肉
C. 屈肘关节
D. 使尺骨环绕桡骨旋内
E. 由正中神经支配

正确答案：A。使桡骨远端环绕尺骨旋后

解析：旋后肌的主要作用是使前臂旋后，即使桡骨远端环绕尺骨旋后（A对），而非使尺骨环绕桡骨旋内（D错），不能屈肘关节（C错），由桡神经支配，而非正中神经（E错）。旋后肌并非是旋后运动的唯一肌肉（B错），如肱二头肌也能使前臂旋后。